患者男性，36岁，已诊断消化性溃疡，近期出现脱水，电解质和酸碱平衡紊乱及营养缺乏，应首先考虑的原因是
A. 厌食
B. 并发胃炎
C. 出血
D. 疼痛
E. 幽门梗阻

正确答案：E。幽门梗阻

解析：幽门梗阻是消化性溃疡的四大并发症之一（上消化道出血、穿孔、幽门梗阻、癌变），幽门梗阻引起胃内容物潴留，临床表现为上腹饱胀不适，餐后明显，呕吐胃内容物，量多，呕吐后反感舒服，可引起失水、低氯低钾性碱中毒，营养不良和体重下降（E对）。